下列药物无抗炎抗风湿作用的是
A. 阿司匹林
B. 布洛芬（异丁苯丙酸）
C. 对乙酰氨基酚（扑热息痛）
D. 保泰松
E. 吲哚美辛

正确答案：C。对乙酰氨基酚（扑热息痛）